关于胎方位的描述正确的是
A. 指胎儿头部与母体骨盆的关系
B. 指母体纵轴与胎儿纵轴的关系
C. 指胎儿先露部指示点与母体骨盆的关系
D. 指最先进入母体骨盆入口的胎儿部分
E. 指胎儿在腹腔中的各种姿势

正确答案：C。指胎儿先露部指示点与母体骨盆的关系

解析：胎方位是胎儿先露部指示点与母体骨盆的关系（C对A错）。母体纵轴与胎儿纵轴的关系是胎产式（B错）。最先进入母体骨盆入口的胎儿部分是胎先露（D错）。胎儿在腹腔中的各种姿势是胎姿势（E错）。